流行性乙型脑炎的发病年龄主要在
A. 成年人
B. 年老体弱者
C. 可通过母体传播给胎儿
D. 10岁以下的儿童
E. 缺乏年龄特征

正确答案：D。10岁以下的儿童

解析：流行性乙型脑炎的发病年龄主要在10岁以下儿童（D对），以2-6岁组发病率最高。大多数成人（A错）因隐性感染而获得免疫力，婴儿（C错）可从母体获得抗体而具有保护作用（E错）。近年来由于儿童和青少年广泛接种疫苗，成人和老年人（B错）的发病率则相对增加。